有关左心室的描述，错误的是
A. 构成心尖及心的左缘
B. 室腔近似圆锥形
C. 左室壁比右室壁厚
D. 左房室口上有二尖瓣
E. 室腔内流动着静脉血

正确答案：E。室腔内流动着静脉血

解析：左心室构成心尖及心的左缘（A对）。室腔近似圆锥形（B对）。左心室壁厚约是右室壁厚的三倍（C对）。左房室口上有二尖瓣（D对）。右心室腔内流动着静脉血，左心室腔内流动着动脉血（E错，为本题正确答案）。